根尖周囊肿、残余囊肿和炎性根侧囊肿的上皮来源为
A. 牙板上皮剩余
B. 上皮根鞘
C. Malassez上皮剩余
D. 釉小皮
E. 缩余釉上皮

正确答案：C。Malassez上皮剩余

解析：Malassez上皮剩余发生根尖周囊肿、残余囊肿和炎性根侧囊肿。掌握“牙体、牙周组织的形成”知识点。